属抑菌作用的抗结核药物是
A. 异烟肼（INH）
B. 利福平（RFP）
C. 链霉素（SM）
D. 乙胺丁醇（EMB）
E. 吡嗪酰胺（PZA）

正确答案：D。乙胺丁醇（EMB）

解析：目前临床上对于结核的治疗多采用抗结核药化学治疗的方案，常用的抗结核药根据其作用机制可分为杀菌药与抑菌药，其中异烟肼（INH）（A错）、利福平（RFP）（B错）、链霉素（SM）（C错）、吡嗪酰胺（PZA）（E错）属于杀菌药，乙胺丁醇（EMB）（D对）属于抑菌作用的抗结核药物。